目前最常用的牙位记录方法为部位记录法，其中阿拉伯数字5代表
A. 中切牙
B. 第一前磨牙
C. 第一磨牙
D. 第二前磨牙
E. 第二磨牙

正确答案：D。第二前磨牙

解析：目前最常用的牙位记录方法为部位记录法：以“+”符号将牙弓分为上、下、左、右四区。每区以阿拉伯数字1～8分别依次代表中切牙至第三磨牙；以罗马数字Ⅰ～Ⅴ分别依次代表每区的乳中切牙至第二乳磨牙。掌握“牙的组成、分类、功能及牙位记录”知识点。